酸性药物在体液中的解离程度可用公式lg（[HA]/[A⁻]）=pKa-pH来计算。已知苯巴比妥的pKa约为7.4，在生理pH为7.4的情况下，其以分子形式存在的比例是
A. 0.3
B. 0.4
C. 0.5
D. 0.75
E. 0.9

正确答案：C。0.5